真阴性率
A. 实际有病而按诊断标准被正确地判为有病的识别能力
B. 实际有病而按诊断标准被判为无病的识别能力
C. 实际无病而按诊断标准被判为无病的识别能力
D. 实际无病而按诊断标准被判为有病的识别能力
E. 正确判断阳性的可能性是错判阳性可能性的倍数

正确答案：C。实际无病而按诊断标准被判为无病的识别能力

解析：本题考查真阴性率。真阴性率又称特异度，是指实际无病而按诊断标准被判为无病的识别能力（C对ABDE错）。